腭扁桃体位于
A. 口腔前庭
B. 腭舌弓与腭咽弓之间的窝内
C. 咽隐窝内
D. 腭咽弓后方的窝内
E. 咽鼓管圆枕深面

正确答案：B。腭舌弓与腭咽弓之间的窝内

解析：腭扁桃体位于腭舌弓与腭咽弓之间的扁桃体窝内(B对)。